关于小脑扁桃体的描述，正确的是
A. 位于小脑下面临近枕骨大孔
B. 位于小脑上面临近小脑幕切迹
C. 颅内压增高时可能形成小脑幕切迹疝
D. 位于颅中窝
E. 无

正确答案：A。位于小脑下面临近枕骨大孔

解析：小脑位居颅后窝（D错），在位于小脑下面临近枕骨大孔处（A对B错）左右各有一突出部称小脑扁桃体。当颅内压增高时，小脑扁桃体可被挤压入枕骨大孔，形成枕骨大孔疝或称小脑扁桃体疝（C错）。